女性，47岁，胆囊结石病史4年，曾先后发作性胆绞痛4次，BUS显示胆囊内充满结石。首选的治疗方法是下列哪─种
A. 口服排石饮液
B. 口服熊去氧胆酸片
C. 口服利胆素片
D. 胆囊切除术
E. 经皮胆镜取石术

正确答案：D。胆囊切除术

解析：中年女性患者，既往有胆结石病史，先后发作胆绞痛4次，BUS显示胆囊内充满结石，首选的治疗方法是胆囊切除术（D对），该患者有胆绞痛的症状且胆囊内充满结石，符合手术治疗的指征，所以应首选胆囊切除术。